某男，60岁。患慢性支气管炎近10年。近日因感风寒病情加重。症见恶寒发热，无汗，咳喘痰稀。医师诊为咳喘，证属风寒水饮，处以功能解表化饮、止咳平喘的小青龙胶囊。该胶囊的处方组成有麻黄、桂枝、干姜、细辛、五味子、白芍、法半夏、炙甘草。药后诸症缓解。目前胶囊剂多由明胶空心胶囊填充制成。关于明胶空心胶囊质量要求的说法，错误的是
A. 含铬不得过百万分之二
B. 干燥失重应为12.5%～17.5%
C. 含重金属不得过百万分之四十
D. 明胶空心胶囊应在30分钟内全部溶化或崩解
E. 含羟苯基甲酯、羟苯乙酯、羟苯丙酯和羟苯丁酯总量不得过0.05%

正确答案：D。明胶空心胶囊应在30分钟内全部溶化或崩解

解析：本题考查的是明胶空心胶囊质量要求。明胶空心胶囊应在10分钟内全部溶化或崩解（D错，为本题正确答案）。明胶空心胶囊应符合《中国药典》规定的性状、鉴别和检查项的质量要求。检查项包括：①崩解时限，应在10分钟内全部溶化或崩解；②黏度，运动黏度不得低于60mm²/s；③对羟基苯甲酸酯类，含羟苯甲酯、羟苯乙酯、羟苯丙酯与羟苯丁酯的总量不得过0.05%（E对）；④干燥失重，应为12.5%～17.5%（B对）；⑤炽灼残渣，分别不得过2.0%（透明）、3.0%（半透明）与5.0%（不透明）；⑥铬，不得过百万分之二（A对）；⑦重金属，不得过百万分之四十（C对）；⑧微生物限度，每1g供试品中细菌数不得过1000cfu、霉菌及酵母菌数不得过100cfu，不得检出大肠埃希菌，每10g供试品中不得检出沙门菌；⑨松紧度、脆碎度、亚硫酸盐（以SO₂计）、氯乙醇和环氧乙烷，均应符合该品种项下的有关规定。